5749—2006）中规定
A. 每毫升饮水中细菌总数不超过10CFU
B. 每毫升饮水中细菌总数不超过100CFU
C. 每毫升饮水中细菌总数不超过1000CFU
D. 每100ml饮水中细菌总数不超过10CFU
E. 每500ml饮水中细菌总数不超过10CFU

正确答案：B。每毫升饮水中细菌总数不超过100CFU

解析：本题考查生活饮用水卫生标准对细菌总数的规定。菌落总数是评价水质清洁度和考核净化效果的指标。菌落总数增多说明水受到了微生物污染，但不能识别其来源，必须结合总大肠菌群指标来判断污染来源及安全程度。我国生活饮用水的卫生标准（GB 5749—2006）中规定每毫升饮水中细菌总数不超过100CFU（B对ACDE错）。